闭孔动脉
A. 分布于大腿内侧群肌
B. 走行于大腿外侧
C. 穿梨状肌下孔至大腿
D. 与旋髂深动脉相吻合
E. 主要分布于股骨头

正确答案：A。分布于大腿内侧群肌

解析：闭孔动脉分布于大腿内侧群肌（A对）和髋关节（E错）。沿骨盆侧壁行向前下，穿闭孔膜（C错）至大腿的内侧（B错）。